关于淋巴干的描述，不正确的是
A. 颈干由颈外侧深淋巴结的输出淋巴管构成，主要收集同侧头颈部的浅、深淋巴管和胸壁上部的浅淋管
B. 锁骨下干由腋尖淋巴结群的输出淋巴管构成，主要收集同侧上肢及部分胸壁(包括脐环以上浅层)的浅、深淋巴管
C. 支气管纵隔干由气管旁淋巴结和纵隔前淋巴结的输出管构成，主要收集同侧胸腔器官和部分胸壁的淋巴管
D. 腰干由左、右侧腰淋巴结群的输出淋巴管构成，主要收集同侧盆部、腹腔内成对器官及大部分腹前壁的淋巴管
E. 肠干由腹腔淋巴结、肠系膜上下淋巴结的淋巴输出管构成，主要收集腹腔内不成对器官的淋巴管

正确答案：D。腰干由左、右侧腰淋巴结群的输出淋巴管构成，主要收集同侧盆部、腹腔内成对器官及大部分腹前壁的淋巴管

解析：腰淋巴结引流腹后壁和腹腔内成对脏器合成腰干，而不是腹前壁（D错，为本题正确答案）。收集头部浅、深淋巴管的输出淋巴管下行，注入颈外侧下深淋巴结，颈外侧下深淋巴结引流颈根部、胸壁上部和乳房上部的淋巴，并收纳颈前、颈外侧浅和颈外侧上深淋巴结的输出淋巴管，输出淋巴管合成颈干（A对）。尖淋巴结收纳腋淋巴结群即：外侧淋巴结、胸肌淋巴结、肩胛下淋巴结、中央淋巴结和锁骨下淋巴结的输出淋巴管，合成锁骨下干，其中，外侧淋巴结收集同侧上肢深、浅淋巴，胸肌淋巴管收集部分胸壁的淋巴（B对）。气管旁淋巴和纵隔前淋巴输出管构成支气管纵隔干，其中纵隔前淋巴收集胸腔器官和部分胸壁淋巴管（C对）。肠干由腹腔淋巴结和肠系膜上下淋巴输出管构成，收集腹腔内不成对器官的淋巴管（E对）。